关于注意说法错误的是
A. 注意是心理活动的指向和集中
B. 注意是一切认识过程的开始
C. 注意是一种孤立独立的心理过程
D. 无意注意是自然发生的，无需意志努力的注意
E. 有意注意是指自觉的，有预定目的的注意

正确答案：C。注意是一种孤立独立的心理过程

解析：本题考查注意的相关内容。注意是人的心理活动集中于一定的人或物（A对），是感知认识过程的开始（B对），而不是独立孤立的心理过程（C错，为本题正确答案）。注意的类型包括：①无意注意是自然发生的，无需意志努力的注意（D对）；②有意注意是指自觉的，有预定目的的注意（E对）；③有意后注意：有目的的、自觉地、不需要意志努力的注意。